患者，女，23岁。痛经9个月，经行不畅，小腹胀痛，拒按，经色紫红，夹有血块，血块下后痛即缓解，脉沉涩。治疗应首选
A. 足三里、太冲、三阴交
B. 中极、次髎、地机
C. 合谷、三阴交
D. 曲池、内庭
E. 合谷、归来

正确答案：B。中极、次髎、地机

解析：该患者的症状可知本病为痛经的实证，选用散寒逐瘀，通经止痛的中极、次髎、地机，中极为任脉经穴，可通调冲任脉之气，散寒行气;次髎为治疗痛经之经验穴；地机为脾经郄穴，阴经的郗穴有止痛的功效，因此可疏调脾经经气而止痛。三穴合用，以达通经散寒、温经止痛之功效（B对）。足三里主治胃痛、呕吐、噎嗝、腹胀、腹泻、痢疾、便秘等胃肠病证；下肢痿痹；癫狂等神志病；乳痈、肠痈等外科疾患；虚劳诸证，为强壮保健要穴，太冲穴主治中风、癫狂痫、小儿惊风；头痛眩晕、耳鸣、目赤肿痛、口歪、咽痛等肝经风热病证；月经不调、痛经、闭经、崩漏、带下等妇科经带病证；黄疸、胁痛、腹胀、呕逆等肝胃病证；癃闭、遗尿；下肢痿痹，足跗肿痛，三阴交主要用于治疗肠鸣腹胀、腹泻等脾胃虚弱诸证；月经不调、带下、阴挺、不孕、滞产等妇产科病症；遗精、阳痿、遗尿等生殖泌尿系统疾患；心悸，失眠，高血压；下肢痿痹；阴虚诸证（A错）。合谷能宣泄气中之热,具有升清降浊,疏风散表,宣通气血的作用（C错）。曲池主治手臂痹痛、上肢不遂等上肢病证、热病、高血压、癫狂、腹痛、吐泻等肠胃病证、咽喉肿痛、齿痛、目赤肿痛等五官热性病证、瘾疹、湿疹、瘰疬等皮肤、外科疾患（D错）。归来主治小腹痛、疝气，月经不调、带下、阴挺等妇科疾病（E错）。